能用于注射剂脱色和除热原的方法是
A. 鲎试验法
B. 气泡点法
C. 超滤法
D. 吸附法
E. 反渗透法

正确答案：D。吸附法

解析：本题考查去除热原的方法。热原能够被活性炭吸附，因此可以采用吸附法（D对）除去热原，同时活性炭还有脱色和助滤的作用。鲎试验法（A错）一般用来进行细菌内毒素的检查。气泡点法（B错）常用于检查微孔滤膜孔径的大小。超滤法（C错）一般使用3～15nm的超滤膜。本法利用高分子薄膜的选择性与渗透性，在常温条件下，依靠一定的压力和流速，达到除去溶液中热原的目的。反渗透法（E错）通过三醋酸纤维素膜或聚酰胺除去热原，是较新发展起来的效果好、具有较高的实用价值的方法。